对强直性脊柱炎临床表现叙述错误的是
A. 早期可无明显体征
B. 早期不会出现局部压痛
C. 随着病情进展可见腰椎前凸消失
D. 随病情进展腰椎活动度降低
E. 病情活动期可有韧带/肌腱与骨附着点压痛

正确答案：B。早期不会出现局部压痛

解析：强直性脊柱炎患者多数起病缓慢而隐匿，早期首发症状常为下腰背痛伴晨僵，早期可无明显体征（A对），亦可出现受累部位局部压痛（B错，为本题正确答案）。由于病理改变为肌腱、韧带和关节囊等附着于骨关节部位的非特异性炎症、纤维化以至骨化，所以病情活动期可有韧带或肌腱与骨附着点压痛（E对）。腰椎为强直性脊柱炎最易受累部位，随病情进展可见腰椎前凸消失（C对），腰椎活动度下降（D对）。